由股神经、闭孔神经同时支配的肌肉是
A. 闭孔内肌
B. 闭孔外肌
C. 缝匠肌
D. 耻骨肌
E. 无

正确答案：D。耻骨肌

解析：股神经肌支主要分布于髂肌、耻骨肌、股四头肌和缝匠肌，闭孔神经主要支配闭孔外肌、长收肌、短收肌、大收肌和股薄肌，偶见发出分支至耻骨肌，所以由股神经、闭孔神经同时支配的肌肉是耻骨肌（D对）。